特指发生于口底的黏液囊肿称为
A. 外渗性黏液囊肿
B. 蛤蟆肿
C. 潴留性黏液囊肿
D. 鳃裂囊肿
E. 甲状舌管囊肿

正确答案：B。蛤蟆肿

解析：舌下囊肿又称蛤蟆肿，是一种特指发生于口底的黏液囊肿。掌握“黏液囊肿”知识点。